在临床医学研究中应切实保护受试者的利益，下列哪一项是错误的
A. 实验研究前必须经过动物实验
B. 实验研究前必须制定严密科学的计划
C. 实验研究前必须有严格的审批监督程序
D. 实验研究前必须详细了解病人身心情况
E. 实验研究结束后必须作出科学报告

正确答案：E。实验研究结束后必须作出科学报告

解析：人体试验必须以维护受试者的利益为前提。因此它必须以动物的实验为基础，并且应在有关专家和具有丰富科学研究及临床经验的医生参与或者指导下进行。同时还要寻求安全、科学的途径和方法，对实验过程中可能出现的特殊情况应有充分的估计且准备好可靠地应急和补救措施，通过严谨的科学计划的制定和审批监督程序，在详细了解受试者身心情况下进行。而做出科学报告与受试者的利益维护问题不相关。掌握“涉及人和动物的医学实验伦理”知识点。